男，62岁。慢性上腹痛、腹胀20余年，腹痛无规律。10年前胃镜诊为慢性萎缩性胃炎。2个月来上腹痛加重，偶有呕吐，体重下降7kg。查体：贫血貌。最可能的诊断是
A. 肝癌
B. 胆囊癌
C. 十二指肠溃疡伴幽门梗阻
D. 胃癌
E. 功能性消化不良

正确答案：D。胃癌

解析：老年男性患者，慢性上腹疼痛、腹胀20余年，加重2个月，体重下降7kg，慢性萎缩性胃炎（胃癌的癌前病变）病史10年，查体为贫血貌，结合患者病史和体查，最可能的诊断为胃癌（D对）。肝癌（P418）（A错）主要表现为肝区疼痛、乏力、消瘦、食欲减退等，晚期可出现贫血、黄疸、腹水及恶病质等，查体可触及质硬、边缘不规则的肝脏。胆囊癌（P452）（B错）常继发于有胆囊结石者，早期无特异性症状，晚期可出现腹胀、食欲差、体重减轻、消瘦，甚至出现黄疸、腹水、全身衰竭。十二指肠溃疡伴幽门梗阻（P342）（C错）主要表现为腹痛和呕吐，呕吐为宿食，有腐败酸臭味，不含胆汁。功能性消化不良（九版内科学P384）（E错）指由胃和十二指肠功能紊乱引起的，而无器质性病变的一组临床综合征，主要表现为餐后饱胀、早饱感、上腹胀痛、嗳气、食欲不振、恶心等，呈持续性或反复发作，患者多有饮食、精神等诱发因素，一般无体重减轻及贫血等。